关于上颌骨支柱及支架结构的叙述中错误的是
A. 均下起上颌骨的牙槽突，上达颅底
B. 在承受咀嚼压力明显的部位，骨质较厚，利于将咀嚼压力传导到颅底
C. 尖牙支柱起于上颌尖牙区的牙槽突，上行沿梨状孔外缘及眶内缘经额突至额骨
D. 颧突支柱主要承受前磨牙区的咀嚼压力
E. 翼突支柱主要承受磨牙区的咀嚼压力

正确答案：D。颧突支柱主要承受前磨牙区的咀嚼压力

解析：上颌骨的支柱结构：上颌骨与咀嚼功能关系密切，在承受咀嚼压力明显的部位，骨质比较厚，以利于将咀嚼压力传导至颅底，形成三对支柱，均下起上颌骨牙槽突，上达颅底。①尖牙支柱（鼻额支柱）：主要承受尖牙区的咀嚼压力，起于上颌尖牙区的牙槽突，上行沿梨状孔外缘及眶内缘经额突至额骨；②颧突支柱：主要承受第一磨牙区的咀嚼压力（D错，为本题正确答案），起于上颌第一磨牙区的牙槽突，沿颧牙槽嵴上行达颧骨后分为二支：一支经眶外缘至额骨，另一支经颧弓至颅底；③翼突支柱：主要承受磨牙区的咀嚼压力，由蝶骨翼突构成，翼突与上颌骨牙槽突的后端（第二第三磨牙区）连接，将咀嚼压力传导至颅底。掌握“上颌骨解剖特点”知识点。